某女，5岁，因淋雨受寒致病，症见面赤身热，咳嗽气促，痰多粘稠，咽痛声哑，证属风寒外束、肺经痰热，治当清肺、解表、化痰、止嗽，宜选用的成药是
A. 鹭鸶咳丸
B. 儿童清肺合剂
C. 清宣止咳颗粒
D. 小儿咳喘灵颗粒
E. 小儿消积止咳口服液

正确答案：B。儿童清肺合剂

解析：本题考查的是儿童清肺丸的功能。某女，5岁，因淋雨受寒致病，症见面赤身热，咳嗽气促，痰多粘稠，咽痛声哑，证属风寒外束、肺经痰热，治当清肺、解表、化痰、止嗽，宜选用的成药是儿童清肺丸（B对）。儿童清肺丸：【功能】清肺，解表，化痰，止嗽。鹭鸶咯丸（A错）：【功能】宣肺，化痰，止咳。清宣止咳颗粒（C错）：【功能】疏风清热，宣肺止咳。小儿咳喘灵颗粒（D错）：【功能】宣肺清热，止咳祛痰，平喘。小儿消积止咳口服液（E错）：【功能】清热肃肺，消积止咳。